模型观测器分析工具包括
A. 分析杆
B. 倒凹尺
C. 描记铅芯
D. 成形蜡刀
E. 以上说法均正确

正确答案：E。以上说法均正确

解析：分析工具：固定在垂直测量臂的下端并与之方向一致，用以测量模型上天然牙轴面和牙槽嵴组织的倒凹。包括分析杆、描记铅芯、倒凹尺、成形蜡刀。掌握“局部义齿类型，肯氏分类及模型观测”知识点。